关于滤过的影响因素的不正确表述是
A. 操作压力越大，滤速越快，因此常采用加压或减压滤过法
B. 滤液的黏度越大，则滤过速度越慢
C. 滤材中毛细管半径越细、阻力越大，不易滤过
D. 由于Poiseuile公式中无温度因素，故温度对滤过速度无影响
E. 滤速与滤材中的毛细管的长度成反比

正确答案：D。由于Poiseuile公式中无温度因素，故温度对滤过速度无影响